切口“乙级愈合”的表现不包括
A. 积液
B. 红肿
C. 血肿
D. 硬结
E. 化脓

正确答案：E。化脓

解析：切口“乙级愈合”的表现不包括化脓（E错，为本题正确答案）。积液（A对）、红肿（B对）、血肿（C对）、硬结（D对）均为“乙级愈合”的表现。